磷霉素使细菌细胞壁受损变薄利于阿莫西林进入菌体属于
A. 敏感化作用
B. 拮抗作用
C. 无关作用
D. 增加毒性
E. 增加疗效

正确答案：E。增加疗效

解析：本题考查药物的联合应用。磷霉素与β-内酰胺类、氨基糖苷类、大环内酯类、氟喹诺酮类抗菌药物联合应用具有相加或协同作用，并减少耐药菌株的产生，提高药物疗效（E对）。敏感化作用（A错）是指一种药物可使组织或受体对另一种药物的敏感性增强。拮抗作用（B错）是指两种药物在同一或不同作用部位或受体上发生拮抗。无关作用（C错）最新版考试指南中未明确说明。增加毒性（D错）：氢溴酸山莨菪碱与哌替啶合用时可增加毒性。